牙周基础治疗的重点是
A. 口腔卫生宜教
B. 菌斑控制
C. 拔除无保留价值的或预后极差的患牙
D. 必要的咬合调整
E. 药物治疗

正确答案：B。菌斑控制

解析：本题考查牙周基础治疗-菌斑控制。牙周基础治疗的重点是菌斑控制（B对）。牙周病的基础治疗是每位牙周病患者都必需的最基本治疗，目的是消除局部及系统致病因素，消除危险因素，使炎症减轻到最低程度。口腔卫生宣教（A错）、拔出无保留价值或预后极差的患牙（C错）、必要的咬合调整（D错）及药物治疗（E错）均属于牙周基础治疗，但因为菌斑是牙周病的始动因子，必须重视菌斑的控制，坚持每天彻底地清除或减少菌斑的形成，因此牙周基础治疗的重点是控制菌斑。